要求在3分钟内崩解或溶化的片剂是
A. 普通片
B. 舌下片
C. 糖衣片
D. 可溶片
E. 肠溶衣片

正确答案：D。可溶片

解析：本题考查片剂的崩解时限。可溶片（D对）的崩解时限为3分钟；普通片剂（A错）的崩解时限为15分钟；舌下片（B错）的崩解时限为5分钟；薄膜衣片如糖衣片（C错）的崩解时限为30分钟；肠溶衣片（E错）要求在盐酸溶液中2小时内不得有裂缝、崩解或软化现象，在pH6.8磷酸盐缓冲液中1小时内全部溶解并通过筛网等。